以下关于可摘局部义齿基托的表述中，正确的是
A. 基托可进入基牙邻面倒凹区
B. 前部基托边缘不应位于舌隆突上
C. 基托应与牙面密合，对牙齿有一定的压力
D. 基托近龈缘处要做缓冲
E. 基托应与牙面轻微离开，不对牙齿形成任何压力

正确答案：D。基托近龈缘处要做缓冲

解析：可摘局部义齿覆盖龈缘区的组织面要缓冲，以免压迫牙龈组织。基托应与余留天然牙邻面和舌面的非倒凹区之间密合而无间隙，基托不应进入基牙邻面和余留牙舌面的倒凹区，以免造成义齿摘戴困难。前牙区腭（舌）侧基托边缘应远离前牙舌侧龈缘，或者位于舌隆突上，并与之密合。掌握“局部义齿的初戴”知识点。